下列各项，除哪项外，均属小儿正常动作发育
A. 6个月会翻身
B. 7个月会独坐
C. 9个月会爬
D. 1岁时眼与手的动作能协调
E. 1岁半左右会走路

正确答案：D。1岁时眼与手的动作能协调

解析：小儿5个月时眼与手的动作取得协调，能有意识地抓取面前的物品，故不需等到1岁（D对）。五版教材言小儿6个月会翻身（A错）。七版教材言6个月时已能独坐片刻，五版教材言7个月会独坐（B错）。七版教材言小孩一般8个月会爬，五版教材言9个月会爬（C错）。七版教材言18个月可跑步和倒退行走，五版教材言1岁半左右会走路（E错）。总体而言，七版教材的小儿正常动作发育更快了。